茶碱属于
A. CYP3A4抑制剂
B. CYP3A4诱导剂
C. CYP2C19底物药物
D. CYP1A2底物药物
E. CYP2D6抑制剂

正确答案：D。CYP1A2底物药物

解析：本题考查肝药酶抑制剂与诱导剂。CYP1A2底物药物（D对）有茶碱、阿米替林、氯丙嗪、氟奋乃静、丙咪嗪、普罗帕酮等。CYP3A4抑制剂（A错）有红霉素、胺碘酮、环丙沙星、克拉霉素、地尔硫䓬、多西环素等。CYP3A4诱导剂（B错）有利福平、糖皮质激素、莫非达尼、苯妥英钠、扑米酮等。CYP2C19底物药物（C错）有奥美拉唑、阿米替林、氟西汀、地西泮、美沙酮、奋乃静等。CYP2D6抑制剂（E错）有胺碘酮、塞来昔布、氯苯那敏、氯丙嗪等。